文字为主的材料若采取个人自行阅读后填报的方式进行预试验，对同一材料，至少需要（）个受访对象
A. 5
B. 10
C. 15
D. 20
E. 25

正确答案：D。20